慢性肾衰竭患者，定期血液透析，每周3次，近两天吃了2㎏橘子，出现口周麻木，四肢乏力，心率43次/分。出现上述症状原因
A. 高钾血症
B. 代谢性酸中毒
C. 高磷血症
D. 低钙血症
E. 高钙血症

正确答案：A。高钾血症

解析：根据题干慢性肾衰竭会导致钾离子排出减少，以及患者吃了含有丰富钾离子的橘子，考虑高钾血症，患者出现口周麻木、四肢乏力、心率减慢符合高钾血症的表现（A对）。代谢性酸中毒、高磷血症、低钙血症、高钙血症不会造成上述症状（CDE错）。